患者，女，40岁。仰卧时腹部呈蛙状，侧卧时下侧腹部明显膨出。应首先虑的是
A. 胃肠胀气
B. 腹腔积液
C. 巨大卵巢囊肿
D. 肥胖
E. 子宫肌瘤

正确答案：B。腹腔积液

解析：患者仰卧时腹部呈蛙状，侧卧时下侧腹部明显膨出，应首先考虑腹腔积液（B对）。胃肠胀气表现为腹部局限性膨隆（A错）。巨大卵巢囊肿可引起高度腹部膨胀，叩诊时可致浊音，于仰卧时常在腹中部，鼓音区则在腹部两侧，浊音不呈移动性（C错）。肥胖是体内脂肪堆积过多而呈现的一种状态（D错）。子宫肌瘤的表现为下腹膨隆（E错）。